1999年夏季某校暴发副伤寒，暴露总人数有4889人，共发病680例，试问在资料分析时疾病的频率指标应选用
A. 感染率
B. 发病率
C. 时点患病率
D. 期间患病率
E. 罹患率

正确答案：E。罹患率

解析：1、局限范围：校内； 2、短时间：夏季； 3、传染病暴发。 符合罹患率定义，选择罹患率更准确。